下列联合用药会产生抗拮作用的是
A. 磺胺甲噁唑合用甲氧啶
B. 华法林合用维生素K
C. 克拉霉素合用奥美拉唑
D. 普鲁卡因合用肾上腺素
E. 哌替啶合用氯丙嗪

正确答案：B。华法林合用维生素K

解析：本题考查药物的相互作用。华法林与维生素K合用（B对）会产生拮抗作用，华法林的抗凝血作用和效应能被维生素K所拮抗，使其抗凝作用下降；磺胺甲噁唑与甲氧苄啶合用（SMZ+TMP）（A错）、普鲁卡因合用肾上腺素（D错）、克拉霉素合用奥美拉唑（C错）；哌替啶与氯丙嗪（E错），均属于协同作用。